为取得固定义齿良好的稳固性应选择
A. 3/4冠
B. 全冠
C. 二面嵌体
D. 高嵌体
E. 以上均可

正确答案：B。全冠

解析：全冠固位体属于固定桥的冠外固位体类型，包括金属全冠、树脂全冠、金属-烤瓷全冠、全瓷冠等。全冠固位体因为覆盖桥基牙的各个牙面，其固位力最强，对桥基牙短小、缺失牙多、桥体跨度长、受（牙合）力大者是最适合选用的固位体。而且对于无髓牙还有保护作用，并能修复基牙的缺损。掌握“固定桥的适应证与禁忌证”知识点。